颌面部创口初期缝合最宽时间为
A. 6h
B. 12h
C. 24h
D. 48h
E. 大于48h的创口，只要没有明显的化脓，清创后仍可作初期缝合

正确答案：E。大于48h的创口，只要没有明显的化脓，清创后仍可作初期缝合

解析：缝合：由于口腔颌面部血运丰富，组织再生力强，在伤后24～48h之内，均可在清创后行严密缝合；甚至超过48h，只要创口无明显化脓感染或组织坏死，在充分清创后，仍可行严密缝合。对估计有可能发生感染者，可在创口内放置引流物；已发生明显感染的创口不应作初期缝合，可采用局部湿敷，待感染控制后，再作处理。掌握“口腔颌面部软组织创伤”知识点。